关于大气中的空气离子，下列说法正确的是
A. 新鲜的清洁空气中轻离子浓度低
B. 污染的空气中轻离子浓度低
C. 空气阳离子对机体有镇静、催眠和降压作用
D. 空气阴离子可引起失眠、烦躁和血压升高
E. 空气阳离子与阴离子对机体的作用相同

正确答案：B。污染的空气中轻离子浓度低

解析：本题考查空气离子的相关内容。大气中带电荷的物质统称为空气离子。根据空气离子的大小以及运动速度对其分类，近地表大气中存在的空气离子有轻离子和重离子两类。轻离子与空气中的悬浮颗粒或水滴结合，形成重离子。因此，新鲜的清洁空气中轻离子浓度高（A错），而污染的空气中轻离子浓度低（B对）。一般认为，空气阴离子对机体具有镇静、催眠、镇痛、镇咳、降压等作用（C错），而阳离子作用则相反（E错），可引起失眠、头痛、烦躁、血压升高等（D错）。海滨、森林、瀑布附近等环境中，大气中阴离子含量较多，有利于机体健康。